脘腹冷痛，呕吐腹泻，多见于
A. 风淫证
B. 暑淫证
C. 寒淫证
D. 湿淫证
E. 火淫证

正确答案：C。寒淫证

解析：寒滞胃肠，胃肠气机不利，和降、传导失常，同时寒最易伤阳气，胃肠失于温养， 故而见腹痛、呕吐、泄泻、肠鸣（C对）。风淫证以恶风、微热、汗出、脉浮缓；或突起风团、瘙痒、麻木，肢体关节游走疼痛，面睑浮肿等为主要表现（A错）。暑淫证候常以发热、汗出、口渴、疲乏等为主要表现（B错）。湿淫证候以头身困重、肢体倦怠、关节酸痛重着等为主要表现（D错）。火淫证候以发热、口渴、面红、便秘、尿黄、舌红、苔黄、脉数等为主要表现（E错）。